肝素长期应用所致严重的不良反应是
A. 血尿酸和肌酐升高
B. 呼吸窘迫综合征
C. 肝坏死
D. 深静脉血栓形成
E. 骨质疏松症

正确答案：E。骨质疏松症

解析：本题考查肝素的不良反应。长期应用肝素可引起骨质疏松症（E对），因此对骨质疏松者禁用。